随着营养、劳动和卫生设施等生活条件的改善，什么成为影响人类健康的重要因素
A. 环境污染
B. 生活方式
C. 现代文明病
D. 心理健康
E. 人口流动

正确答案：B。生活方式